支原体肺炎宜选
A. 青霉素
B. 氯霉素
C. 土霉素
D. 多西环素
E. 万古霉素

正确答案：D。多西环素